在致畸试验中，活胎检测内容不包括
A. 外观畸形检查
B. 组织病理学检查
C. 内脏畸形检查
D. 体重测量
E. 骨骼畸形检查

正确答案：B。组织病理学检查